影响环境污染物毒性大小和毒作用性质的决定因素是化学物的
A. 理化性质
B. 剂量
C. 作用持续时间
D. 联合作用

正确答案：A。理化性质

解析：本题考查影响环境污染物毒性大小和毒作用性质的决定因素。影响环境污染物毒性大小和毒作用性质的决定因素是化学物的理化性质（A对BCD错）。